能杀伤细胞的细胞因子是
A. IL-2
B. TNFα
C. 干扰素
D. IL-4
E. IL-1

正确答案：B。TNFα

解析：肿瘤坏死因子（TNF）是一种能使肿瘤发生出血性坏死的细胞因子，包括TNF-α（B对）和LT（淋巴毒素），在调节适应性免疫、杀伤靶细胞和诱导细胞凋亡等过程中发挥重要的作用。IL-2（A错）主要功能是刺激T细胞的生长和分化，激活NK细胞和巨噬细胞，促进CTL功能。干扰素（C错）主要作用是干扰病毒的感染和复制。IL-4（D错）主要功能是刺激B细胞增值，参与Th2细胞分化，促进嗜酸性粒细胞、嗜碱性粒细胞和肥大细胞发育，促进IgE生成。IL-1（E错）主要功能是参与T细胞、NK细胞和巨噬细胞活化，诱导急性期反应蛋白和发热。